何时做头部CT检查，诊断脑梗死阳性率较高
A. 发病6小时以后
B. 发病12小时以后
C. 发病48小时以后
D. 发病18小时以后
E. 发病1周以后

正确答案：C。发病48小时以后

解析：脑梗死（CI）是缺血性卒中的总称，包括脑血栓形成、腔隙性梗死和脑栓塞等，约占全部脑卒中的70%，是由于脑血液供应障碍引起脑部病变。脑梗死发病24～48h后，脑CT扫描可见相应部位的低密度灶，边界欠清晰，可有一定的占位效应（C对）。脑MRI检查能较早期发现脑梗死，表现为加权图像上病灶区在T1呈低信号，在T2呈高信号，MRI能发现较小的梗死病灶。